属于二肽基肽酶-4抑制药的是
A. 格列本脲
B. 那格列奈
C. 沙格列汀
D. 吡格列酮
E. 卡格列净

正确答案：C。沙格列汀

解析：本题考查口服降糖药的分类。二肽基肽酶-4抑制剂也称为列汀类药物，常用的有磷酸西格列汀、维格列汀、沙格列汀（C对）、阿格列汀等。